胸膜腔内压等于
A. 大气压﹣跨气道压
B. 大气压﹢跨肺压
C. 大气压﹢跨胸壁压
D. 大气压﹣肺回缩压
E. E.大气压﹢肺回缩压

正确答案：D。大气压﹣肺回缩压